以下不会影响骨折愈合的是
A. 患者的年龄
B. 损伤程度
C. 是否及时准确复位
D. 患者的性别
E. 是否合并感染

正确答案：D。患者的性别

解析：在骨折愈合过程中，骨膜中成骨细胞增殖起着重要的作用，因此在处理骨折时应注意保护骨膜，不使其再受损伤，以利骨折愈合。骨折愈合还与患者的年龄、损伤程度、是否及时准确复位、牢靠固定及是否合并感染等因素有关。掌握“颧骨及颧弓、眼眶骨折及骨折愈合过程”知识点。